治疗青光眼宜选用
A. 左氧氟沙星滴眼液
B. 复方托吡卡胺滴眼液
C. 毛果芸香碱滴眼液
D. 碘苷滴眼液
E. 阿昔洛韦滴眼液

正确答案：C。毛果芸香碱滴眼液

解析：本题考查毛果芸香碱。毛果芸香碱（C对）是拟M胆碱药，对于闭角型青光眼及开角型青光眼均有治疗作用。左氧氟沙星（A错）属于抗菌药。复方托吡卡胺（B错）是散瞳药，常用于眼底检查。碘苷（D错）主要用于单纯疱疹性角膜炎及其它疱疹性眼病。阿昔洛韦（E错）主要用于单纯疱疹性角膜炎。